男孩，5岁。持续高热1周。查体：T39℃，P128次/分，R36次/分。热病容，双眼结合膜充血，口唇干裂，可见草莓舌，皮肤呈弥漫性红斑，颈部浅表淋巴结肿大，心音有力，手足指（趾）硬性水肿。最可能的诊断是
A. 川崎病
B. 手足口病
C. 败血症
D. 风湿热
E. 猩红热

正确答案：A。川崎病

解析：儿童男性患者，持续高热1周。查体：T39℃（正常值36～37℃），P128次/分（80～90次/分），R36次/分（正常值20～30次/分）。热病容，双眼结合膜充血，口唇干裂，可见草莓舌，皮肤呈弥漫性红斑，颈部浅表淋巴结肿大，心音有力，手足指（趾）硬性水肿。综合患者的症状、体征和辅助检查，最可能的诊断是川崎病（A对）。手足口病（B错）多发生于5岁以下儿童，口腔、手足部位可出现典型皮疹。败血症（C错）多有寒战，多无手足指（趾）硬性水肿。风湿热（D错）有5个主要表现：游走性多发性关节炎、心脏炎、皮下结节、环形红斑、舞蹈病。猩红热（E错）疹退后有明显的脱屑，多见杨梅舌。